婴儿期若断离母乳，婴儿总奶量需要维持在
A. 500ml/d左右
B. 600ml/d左右
C. 700ml/d左右
D. 800ml/d左右
E. 1000ml/d左右

正确答案：D。800ml/d左右

解析：本题考查婴儿喂养方式的相关内容。婴儿满6月龄始逐渐以婴儿配方替代入乳，配方乳量至800ml/d（D对ABCE错）即可完全替代母乳（12～18月龄）。